成为职业病诊断医师应当具备的条件之一是从事职业病诊疗相关工作
A. 1年以上
B. 2年以上
C. 3年以上
D. 5年以上
E. 10年以上

正确答案：D。5年以上